消化性溃疡复发的主要病源性原因是
A. 服用NSAIDs的同时服用了米索前列醇
B. 没有下决心戒烟，且吸烟量更大
C. 幽门螺杆菌的感染没有彻底清除
D. 过量饮用烈性酒和食用刺激性食物
E. 恐惧、焦虑情绪紧张导致迷走神经兴奋

正确答案：C。幽门螺杆菌的感染没有彻底清除

解析：本题考查消化道溃疡的复发。消化性溃疡复发的主要病源性原因是幽门螺杆菌的感染没有彻底清除（C对）。没有下决心戒烟，且吸烟量更大（B错）、过量饮用烈性酒和食用刺激性食物（D错）、恐惧、焦虑情绪紧张导致迷走神经兴奋（E错）会引起消化性溃疡的复发，但不属于病源性原因。溃疡活动期应停用NSAIDs等会导致胃黏膜损害药物（A错）。